为研究某种疾病的发生与遗传和环境的关系孰大，可用
A. 描述性流行病学方法
B. 分析性流行病学方法
C. 理论性流行病学方法
D. 移民流行病学方法
E. 遗传流行病学方法

正确答案：D。移民流行病学方法